患者因受精神刺激而气逆喘息，面红目赤，呕血昏厥猝倒。其病机是
A. 怒则气上
B. 悲则气消
C. 喜则气缓
D. 思则气结
E. 恐则气下

正确答案：A。怒则气上

解析：怒则气上，指大怒致使肝气上逆，甚至血随气逆的病机变化。临床表现：头胀头痛、面红目赤、急躁易怒；血随气逆则呕血，甚至昏厥晕倒（A对）。悲则气消（B错）常见意志消沉，精神不振，气短胸闷，乏力懒言等症。喜则气缓（C错）轻者出现心悸失眠、少气无力等，重者神志失常、狂乱，或见心气暴脱而大汗淋漓、脉微欲绝。思则气结（D错）临床可见心悸失眠健忘和倦怠乏力、食少腹胀等。恐则气下（E错）临床可见二便失禁，遗精、滑精、骨痿等症。